《中国药典》规定，以蒽醌类化合物为质量控制成分的中药有
A. 大黄
B. 虎杖
C. 肉桂
D. 芦荟
E. 决明子

正确答案：A、B、D、E。大黄；虎杖；芦荟；决明子

解析：本题考查的是含醌类化合物的常用中药。《中国药典》规定，以蒽醌类化合物为质量控制成分的中药有大黄（A对）、虎杖（B对）、芦荟（D对）与决明子（E对）。大黄中的主要蒽醌类成分及其化学结构：从大黄中分离得到蒽醌、二蒽酮、芪、苯丁酮、单宁、萘色酮等不同种类的80多种化合物，大体上可分为蒽醌类、多糖类与鞣质类。其中蒽醌类及其衍生物含量为3%～5%，分为游离型与结合型。游离型包括大黄酸、大黄素、土大黄素、芦荟大黄素、大黄素甲醚、异大黄素、大黄酚、虫漆酸D等。结合型主要包括蒽醌苷和双蒽酮苷。双蒽酮苷中有番泻苷A、B、C、D、E、F。《中国药典》以总蒽醌和游离蒽醌为指标成分，采用高效液相色谱法测定药材和饮片中芦荟大黄素、大黄酸、大黄素、大黄酚和大黄素甲醚等总蒽醌的含量，要求药材总蒽醌不得少于1.5%，游离蒽醌不得少于0.20%。虎杖主要含有蒽醌类化合物：蒽醌类成分包括大黄素、大黄酚、大黄酸等。此外，还含有非蒽醌类的化合物如虎杖苷等。《中国药典》采用高效液相色谱法测定药材中大黄素和虎杖苷的含量，大黄素不得少于0.60%，虎杖苷不得少于0.15%。芦荟中主要活性成分是羟基蒽醌类衍生物，包括芦荟大黄素、大黄酸、大黄素、大黄酚、大黄素甲醚等。《中国药典》以芦荟苷为指标成分进行含量测定，芦荟苷含量不得少于16.0%。决明子中含有蒽醌类、萘并吡咯酮类、脂肪酸类等化学成分。其中，蒽醌类化合物为其主要成分，含量约1%，主要为大黄酚、大黄素甲醚、决明素、橙黄决明素、黄决明素、美决明素、葡萄糖美决明素、葡萄糖橙黄决明素。《中国药典》以大黄酚、橙黄决明素为指标成分进行含量测定，含量分别不得少于0.20%和0.80%。肉桂（C错）中主要化学成分及其结构：肉桂皮含挥发油1%～2%。《中国药典》以桂皮醛为指标成分进行含量测定，并以挥发油作为质量控制指标，要求其含量不得少于1.2%（ml/g）。油中的主要成分为肉桂醛含量达75%～85%，并含少量乙酸桂皮酯、肉桂酸、乙酸苯丙酯等。